特质性药物毒性是指药物在体内发生代谢作用，生成有反应活性的代谢物而引发的毒性作用。属于特质性药物毒性的是
A. 非甾体抗炎药罗非昔布引发的心肌梗塞
B. 抗过敏药特非那定导致的药源性心律失常
C. 抗精神病药氯丙嗪引起的锥体外系反应
D. 抗高血压药依那普利引起的刺激性干咳
E. 降血糖药曲格列酮引起的硬化性腹膜炎

正确答案：E。降血糖药曲格列酮引起的硬化性腹膜炎

解析：本题考查特质性药物毒性。属于特质性药物毒性的是降血糖药曲格列酮引起的硬化性腹膜（E对）。药物在体内发生代谢作用，生成有反应活性的物质，引发毒性作用，这类毒性被称作特质性药物毒性（IDT），IDT不同于药物的副作用，特点在于：①并非与药理作用同时发生，一般呈滞后效应；②剂量-效应关系不明显；③产生的后果通常比副作用严重。非甾体抗炎药罗非昔布引发的心肌梗塞（A错）、抗过敏药特非那定导致的药源性心律失常（B错）、抗精神病药氯丙嗪引起的锥体外系反应（C错）、抗高血压药依那普利引起的刺激性干咳（D错）都属于药物的副作用，而不是特质性药物毒性。